患者，女，20岁。每逢生气时即咳逆阵作，口苦咽干，胸胁胀痛，咳时面赤，舌红苔薄黄，脉弦数。治疗应首选
A. 加减泻白散合黛蛤散
B. 龙胆泻肝汤合黛蛤散
C. 清金化痰汤合桔梗汤
D. 二陈汤合柴胡疏肝散
E. 桑白皮汤合柴胡疏肝散

正确答案：A。加减泻白散合黛蛤散

解析：题中患者以咳逆阵作为主症，故诊断为咳嗽。咳逆阵作为肝气郁结化火，上逆侮肺，肺失肃降所致；肝火上炎，故口苦咽干，咳时面赤；肝脉布两胁，上注于肺，肝肺络气不和，故胸胁胀痛；生气致气愈滞，故每逢生气即发作；舌红苔薄黄，脉弦数为肝火肺热之象，故辨为肝火犯肺证。治宜清肺泻肝，顺气降火，首选加减泻白散合黛蛤散（A对）。龙胆泻肝汤功能清泻肝胆实火，清理肝胆湿热，黛蛤散功能清肝化痰，两者相合无肃肺之功（B错）。清金化痰汤功能清热化痰，桔梗汤功能宣肺止咳，祛痰排脓，两方相合无泻肝火之功（C错）。二陈汤功能燥湿化痰，理气和中，柴胡疏肝散功能疏肝解郁，活血止痛，两方相合，无泻肝火，肃肺之功（D错）。桑白皮汤功能清热肃肺化痰，柴胡疏肝散功能疏肝解郁，活血止痛，两方相合无泻肝火之功（E错）。